应激时体内分泌减少的激素是
A. 儿茶酚胺
B. 胰高血糖素
C. ACTH
D. 糖皮质激素
E. 胰岛素

正确答案：E。胰岛素

解析：胰岛素（E对）是应激时体内分泌减少的激素。